能够产生带荧光的水溶性色素使培养基变为亮绿色的细菌是
A. 金黄色葡萄球菌
B. β溶血性链球菌
C. 铜绿假单胞菌
D. 肺炎支原体
E. 沙眼衣原体

正确答案：C。铜绿假单胞菌

解析：铜绿假单胞菌的某些菌株能够产生带荧光的水溶性色素（绿脓素和青脓素），使培养基变为亮绿色。掌握“军团菌、铜绿假单胞菌及白喉棒状杆菌”知识点。